炼钢、陶瓷、铸造工种属于何种作业
A. 高温低辐射作业
B. 高气湿作业
C. 高温高湿作业
D. 干热作业

正确答案：D。干热作业

解析：本题考查高温作业的分类。一般高温作业分为三种类型：①高温强辐射作业（D对ABC错），又叫干热作业。常发生在冶金工业的炼焦、炼铁、炼钢、轧钢等车间；机械制造工业的铸造、锻造、热处理等车间；建筑材料行业的陶瓷、玻璃、砖瓦等使用工业炉窑的车间和作业场所：火力发电厂和轮船上的锅炉间等场所。②高温高湿作业，常发生在印染、细丝、造纸等工业中对液体加热或蒸煮时。潮湿的深矿井内气温可达30℃以上，相对湿度也可达到95%以上，如通风不良就形成高温、高湿和低气流的不良气象条件，即湿热环境。③夏季露天作业，也是一类常见高温作业，如农业、建筑、搬运等露天劳动的高温和热辐射主要来源是太阳辐射及地表被加热后形成的二次热辐射源。